有致畸作用，孕妇禁用的药物是
A. 乙胺嘧啶
B. 奎宁
C. 伯氨喹
D. 青蒿素
E. 氯喹

正确答案：E。氯喹